结核分枝杆菌中对人的感染率和致病率最高的是
A. 结核分枝杆菌
B. 牛分枝杆菌
C. 非洲型分枝杆菌
D. 田鼠分枝杆菌
E. 亚洲型分枝杆菌

正确答案：A。结核分枝杆菌